实热证可见
A. 汗出蒸蒸
B. 动则汗出
C. 睡时汗出
D. 半身汗出
E. 冷汗淋漓

正确答案：A。汗出蒸蒸

解析：汗出蒸蒸多因风热内传，或风寒入里化热，正邪相搏，正盛邪实，阳热内盛，蒸达于外所致，属里实热证（A对）。动则出汗多见于气虚证和阳虚证（B错）。睡时汗出多见于阴虚证（C错）。半身汗出多见于痿病、中风及截瘫患者；多因风痰、痰瘀、风湿等阻滞经络，营卫不能周流，气血失和所致（D错）。冷汗淋漓，面色苍白，肢冷脉微者，属亡阳之汗，为阳气亡脱，津随气泄之危象（E错）。